X线片表现正常骨质被纤维组织代替，且颌骨内有囊性密度减低区，边界不清，有硬化边缘，考虑为
A. 嗜酸性肉芽肿
B. 汉-许-克病
C. 骨纤维异常增殖症-囊样型
D. 骨纤维异常增殖症-混合型
E. Albright综合征

正确答案：C。骨纤维异常增殖症-囊样型

解析：本题考查骨纤维异常增殖症。X线片表现正常骨质被纤维组织代替，且颌骨内有囊性密度减低区，边界不清，有硬化边缘，考虑为骨纤维异常增殖症-囊样型（C对）。骨纤维异常增殖症又称为骨纤维结构不良，其特征是正常骨组织被纤维骨组织替代，分为三大类：1）透射性改变：又称为囊性型，X线表现单囊或者多囊性密度减低病变，边界不清，可有或无硬化边缘。2）阻射性改变：包括“橘皮”样型、毛玻璃型及硬化型。病变密度高于正常且均匀一致，逐渐移行至正常骨。3）透射及阻射混合性改变。